下列各项，除哪项外，均属肾气不固的小便异常
A. 夜尿增多
B. 遗尿
C. 余沥不尽
D. 小便失禁
E. 小便涩痛

正确答案：E。小便涩痛

解析：湿热郁蒸膀胱，气化不行，下迫尿道，故小便涩痛（E对）。肾气亏虚，固摄无权，膀胱失约，则小便频数清长，尿后余沥不尽（C错），夜尿增多（A错），遗尿（B错），小便失禁（D错）。